评价靶向制剂靶向性的参数有
A. 相对摄取率
B. 波动度
C. 靶向效率
D. 峰浓度比
E. 平均稳态血药浓度

正确答案：A、C、D。相对摄取率；靶向效率；峰浓度比

解析：本题考查靶向制剂的评价。靶向性可由以下三个参数评价：相对摄取率（rₑ）（A对）、靶向效率（tₑ）（C对）、峰浓度比（Cₑ）（D对）。波动度（B错）（DF）用于描述多剂量给药达稳态后一个给药间隔内的血药浓度波动情况，是指稳态时峰浓度与谷浓度之差对平均稳态血药浓度的百分比。平均稳态血药浓度（E错）是指重复给药达稳态后，在一个给药间隔时间内，血药-时曲线下面积除以给药间隔时间τ的商值。